原植物属于木兰科的药材是
A. 肉桂
B. 秦皮
C. 厚朴
D. 杜仲
E. 黄柏

正确答案：C。厚朴

解析：本题考查的是厚朴为的来源。原植物属于木兰科的药材是厚朴（C对）。厚朴：【来源】为木兰科植物厚朴及凹叶厚朴的干燥干皮、枝皮和根皮。肉桂（A错）：【来源】为樟科植物肉桂的干燥树皮。秦皮（B错）：【来源】为木犀科植物苦枥白蜡树、白蜡树、尖叶白蜡树或宿柱白蜡树的干燥枝皮或干皮。杜仲（D错）：【来源】为杜仲科植物杜仲的干燥树皮。黄柏（E错）：【来源】为芸香科植物黄皮树的干燥树皮。